常与凡士林合用，调节渗透性与吸水性的软膏基质是
A. 蜂蜡
B. 石蜡
C. 羊毛脂
D. 植物油
E. 氢化植物油

正确答案：C。羊毛脂

解析：本题考查的是软膏剂的基质。常与凡士林合用，调节渗透性与吸水性的软膏基质是羊毛脂（C对）。羊毛脂：又称无水羊毛脂，为淡黄色黏稠半固体，熔点36℃～42℃，因含胆甾醇、异胆甾醇与羟基胆甾醇及其酯而有较大的吸水性，可吸水150%、甘油140%、70%的乙醇40%。由于羊毛脂的组成与皮脂分泌物相近，故可提高软膏中药物的渗透性。常与凡士林合用，调节凡士林的渗透性和吸水性。蜂蜡（A错）：有黄蜡、白蜡之分。白蜡系由黄蜡漂白精制而成，主要成分为棕榈酸蜂蜡醇酯，熔点为62℃～67℃。常用调节软膏的稠度或增加稳定性。因含有少量的游离高级脂肪醇而有乳化作用，可作辅助乳化剂。石蜡（B错）：石蜡为多种固体烃的混合物，可与脂肪油、蜂蜡等熔合。主要用于调节软膏稠度。植物油（D错）与氢化植物油（E错）均属于油脂类基质。因含有不饱和双键，易氧化酸败，可加入抗氧化剂和防腐剂改善。植物油常与熔点较高的蜡类熔合制成稠度适宜的基质，如中药油膏常用麻油与蜂蜡熔合为基质。